坏死性涎腺化生与粘液表皮样癌的鉴别要点是
A. 无腺小叶
B. 无鳞状化生
C. 无鳞状细胞团块
D. 无粘液细胞
E. 无表皮样细胞和中间细胞

正确答案：E。无表皮样细胞和中间细胞

解析：坏死性涎腺化生病理改变为：溃疡周围的表面上皮呈假上皮瘤样增生，腺小叶坏死，腺泡壁溶解消失，粘液外溢形成粘液池。腺导管有明显的鳞状化生，形成大小不等的上皮岛或上皮条索，有的腺小叶完全被鳞状细胞团取代，易被误认为高分化的鳞状细胞癌或粘液表皮样癌。但化生的鳞状细胞形态较一致，无核异形性或间变。腺体内有弥散的中性粒细胞、淋巴细胞及浆细胞浸润。粘液表皮样癌的肿瘤特征：存在有鳞状细胞、粘液细胞和中间细胞。粘液细胞常组成实性团块或衬里囊腔，呈粘液卡红或PAS染色阳性。囊腔破裂，粘液可流入组织内引起炎症反应，肉芽组织形成伴胆固醇结晶和异物巨细胞。表皮样细胞或鳞状细胞有细胞间桥，角化罕见。表皮样细胞常发生水性变而成透明细胞，偶见透明细胞为肿瘤的主要成分。掌握“坏死性唾液腺化生与舍格伦综合征”知识点。